在糖尿病的筛检方案中，A医师将餐后血糖水平定为160mg/100ml，而B医师将餐后血糖试验定为140mg/100ml。这就意味着
A. 前者的灵敏度比后者高
B. 前者的特异度比后者高
C. 前者的假阳性率比后者高
D. 前者的假阴性率比后者高
E. 前者的阳性预测值比后者高

正确答案：B。前者的特异度比后者高

解析：本题考查筛检中的特异度。特异度又称真阴性率，即实际无病且被筛检试验标准判断为阴性的百分比。它反映了筛检试验鉴别排除病人的能力。本题中A医师将餐后血糖水平定为160mg/100ml，而B医师将餐后血糖试验定为140mg/100ml，可知A医师血糖范围定的较宽，排除病人的能力较强，故前者的特异度比后者高（B对ACDE错）。